成人肺结核临床常见的类型是
A. 局灶性肺结核
B. 干酪样肺炎
C. 浸润性肺结核
D. 肺结核球
E. 慢性纤维空洞性肺结核

正确答案：C。浸润性肺结核

解析：肺结核病可分为原发性和继发性两大类，成人肺结核多为继发性肺结核病，临床上继发性肺结核病主要分为以下几种类型：局灶性肺结核（A）、浸润性肺结核（C）、慢性纤维空洞性肺结（E）、干酪样肺炎（B）和肺结核球（D），其中最常见的类型是浸润性肺结核（C对）。